下列哪项不是大气化学性污染物的自净方式
A. 扩散
B. 微生物分解
C. 氧化
D. 植物吸收
E. 沉降

正确答案：B。微生物分解

解析：本题考查大气化学性污染物的自净方式。大气的自净是指大气中的污染物在物理、化学和生物学作用下，逐渐减少到无害程度或者消失的过程，主要有以下几种方式：1.扩散（A对）和沉降（E对）：是大气污染物净化的主要方式。扩散一方面能将污染物稀释，另一方面可以将部分污染物转移出去。污染物也可依靠自身重力，从空气中逐渐降落到水、土壤等环境介质中。2.发生氧化（C对）和中和反应：例如，CO可以被氧化为CO₂，SO₂可以与氨或其他碱性灰尘发生中和反应。3.被植物吸附和吸收（D对）：有些植物能吸收大气污染物，从而净化空气。微生物分解（B错，为本题正确答案）不是大气化学性污染物的自净方式。